1型糖尿病的主要特点是
A. 多见于40岁以上的成年人
B. 易发生高渗性非酮症性糖尿病昏迷
C. 自身免疫介导的胰岛β细胞破坏
D. 早期常不需要胰岛素治疗
E. 大部分有体重超重或肥胖

正确答案：C。自身免疫介导的胰岛β细胞破坏

解析：1型糖尿病绝大多数是自身免疫性疾病，是由某些外界因素激活T淋巴细胞介导的一系列自身免疫反应，引起选择性胰岛β细胞破坏，体内胰岛素分泌不足进行性加重而最终导致糖尿病（C对）。1型糖尿病起病年龄多小于30岁（A错），多见于40岁以上成年人的为2型糖尿病。1型糖尿病病人胰岛B细胞受损严重，胰岛素分泌绝对不足，胰岛素绝对缺乏，易并发酮症酸中毒，高渗性非酮症性糖尿病昏迷（B错）主要见于老年T2DM患者。1型糖尿病病人胰岛B细胞受损严重，胰岛素分泌绝对不足，胰岛素绝对缺乏，多数患者起病初期都需要胰岛素治疗（P729）（D错）。1型糖尿病起病多为青少年时期，多有体重下降，2型糖尿病病人大部分有体重超重或肥胖（E错）。